诊断支气管扩张首选的检查是
A. 胸部超声
B. 胸部高分辨CT
C. 支气管造影
D. 胸部X线
E. 胸部磁共振

正确答案：B。胸部高分辨CT

解析：确诊支气管扩张诊断的影像学检查为支气管碘脂质造影，因其为创伤性检查，现已被高分辨CT（HRCT）所取代（B对C错），HRCT可在横断面上清楚地显示扩张的支气管，兼具无创、易重复、易接受的特点。胸部X线（D错）平片检查时，囊状支气管扩张的气道表现为显著的囊腔，腔内可存在气液平面，囊腔内无气液平面时，很难与大疱性肺气肿或严重肺间质病变的蜂窝肺鉴别，且病变轻时影像学检查可正常。胸部超声（A错）对液体的敏感性很高，主要用于胸腔积液的检查。胸部磁共振（E错）对肺门淋巴结肿大与中心型肺癌的诊断帮助较大，因不能良好的反应支气管的状况，故不作为支气管扩张的常规检查方法。